缺铁性贫血的氧分压
A. 上升
B. 下降
C. 不变
D. 逐渐下降
E. 逐渐上升

正确答案：C。不变

解析：缺铁性贫血的氧分压不变（C对）。血氧分压为物理溶解于血液中的氧所产生的张力，其高低主要取决于吸入气的氧分压和肺的通气与弥散功能。当缺铁性贫血时血红蛋白减少，使血液携氧能力下降，但是物理溶解的氧量不变，所以氧分压不会发生变化，此时的缺氧为等张性缺氧。